下述不良反应哪项是胰岛素不具有的
A. 过敏
B. 低血糖
C. 急性耐受性
D. 慢性耐受性
E. 肝损伤

正确答案：E。肝损伤